卫生行政部门履行监督检查职责时，有权采取下列措施，但不包括
A. 进入被检查单位了解情况，调查取证
B. 进入职业病危害现场，了解情况，调查取证
C. 查阅或者复制与违反职业病防治法律、法规的行为有关的资料
D. 责令违反职业病防治法律，法规的单位和个人停止违法所为
E. 责令暂停导致职业病危害事故的作业

正确答案：E。责令暂停导致职业病危害事故的作业